预防四季豆中毒的措施是
A. 烹调前用水浸泡并洗净
B. 烹调时要烧熟煮透
C. 烹调时加醋
D. 熟食要冷藏
E. 避免重复加热

正确答案：B。烹调时要烧熟煮透